与因人制宜治则相关的有
A. 年龄
B. 性别
C. 体质
D. 地域
E. 职业

正确答案：A、B、C、E。年龄；性别；体质；职业

解析：本题考查的是因人制宜的原则和临床应用。与因人制宜治则相关的有年龄（A对）、性别（B对）、体质（C对）与职业（E对）。因人制宜：根据患者年龄、性别、体质、生活习惯等不同特点，来考虑治疗用药的原则，叫做“因人制宜”。地域（D错）属于因地制宜。因地制宜：根据不同地域的地理特点，来考虑治疗用药的原则，即为“因地制宜”。